口腔颌面部感染特点，不正确的是
A. 感染途径以腺源性为主
B. 需氧菌与厌氧菌的混合感染最多
C. 牙源性感染极易波及颌骨与颌周软组织
D. 口腔颌面部感染沿相应淋巴引流途径扩散，可发生区域淋巴结炎
E. 正常时即有大量微生物存在，机体抵抗力下降时发生感染

正确答案：A。感染途径以腺源性为主

解析：本题考查口腔颌面部感染的特点。牙源性途径是口腔颌面部感染的主要来源（A错，为本题的正确答案）。口腔颌面部感染中需氧菌与厌氧菌的混合感染最多见（B对）。牙源性感染易向根尖、牙槽突、颌骨以及颌面部蜂窝组织间隙扩散（C对）。面颈部有丰富的淋巴结，感染时可沿相应淋巴结引流途径扩散，发生区域性的淋巴结炎（D对）。口腔正常时即有大量的微生物存在，当遭受损伤、手术或全身抵抗力下降等因素影响下，可导致感染发生（E对）。